具有公共卫生学意义的指标是
A. 人群归因危险度
B. 特异危险度
C. 归因危险度百分比
D. 相对危险度
E. 人群归因危险度百分比

正确答案：B。特异危险度